少阴经头痛的特征是
A. 前额连眉棱骨痛
B. 一侧太阳穴处痛
C. 头后部连项痛
D. 头痛连齿
E. 头痛晕沉

正确答案：D。头痛连齿

解析：齿为肾之余，足少阴经络肾，头痛连齿为少阴经头痛的特征（D对）。阳明经与任脉行于头前，故前额连眉棱骨痛（A错），病在阳明经。少阳经起于目外眦，上抵头角，行于头侧部，故头一侧太阳穴处痛（B错），病在少阳经。太阳经与督脉行于头后，故后头连项痛（C错），病在太阳经。头痛晕沉（E错）多为肝阳上亢所致。